链球菌感染后急性肾小球肾炎必有的临床表现是
A. 肉眼血尿
B. 镜下血尿
C. 水肿
D. 高血压
E. 肾功能异常

正确答案：B。镜下血尿

解析：链球菌感染后急性肾小球肾炎的主要临床表现为肾炎综合征，包括血尿、蛋白尿、水肿、高血压等，其必有的临床表现是镜下血尿（B对），也是最主要和最先发生的临床表现。如果肾损害严重还可出现肉眼血尿（A错）、水肿（C错）、高血压（D错）、肾功能异常（E错）等其他表现。